影响体温的环境气象因素主要是
A. 气流
B. 气温
C. 气湿
D. 气压
E. 风速

正确答案：B。气温